为增加粘结力，粘结之前预备体表面需作的处理中不包括
A. 清洁
B. 干燥
C. 去油污
D. 酸蚀
E. 涂硅烷偶联剂

正确答案：E。涂硅烷偶联剂

解析：粘结之前预备体表面需作：清洁、干燥、去油污、酸蚀等操作，以增加修复体粘结力。掌握“修复材料、金瓷结合及树脂粘结机制”知识点。